紫杉醇的抗癌作用机制
A. 影响蛋白质的合成和功能
B. 直接破坏DNA结构
C. 干扰核酸生物合成
D. 干扰生物碱合成
E. 影响体内激素平衡

正确答案：A。影响蛋白质的合成和功能

解析：本题考查紫杉醇的作用机制。紫杉醇的抗癌作用机制是影响蛋白质的合成和功能（A对）。紫杉醇为微管蛋白活性抑制剂，能促进微管聚合，同时抑制微管的解聚，从而使纺锤体失去正常功能，细胞有丝分裂停止。直接破坏DNA结构（B错）的抗肿瘤药有环磷酰胺、塞替派、顺铂、喜树碱等。干扰核酸生物合成（C错）的抗肿瘤药有甲氨蝶呤、氟尿嘧啶、阿糖胞苷等。干扰生物碱合成（D错）不能达到抗癌作用。影响体内激素平衡（E错）的抗肿瘤药有肾上腺皮质激素、雌激素、雄激素及其拮抗剂，如他莫昔芬、甲地孕酮等。